mRNA的特点除外的是
A. 不稳定
B. 代谢活跃
C. 更新迅速
D. 寿命较短
E. 分子大小较一致

正确答案：E。分子大小较一致

解析：mRNA一般都不稳定，代谢活跃，更新迅速，寿命较短。mRNA的分子大小变异非常大。掌握“RNA”知识点。